在医疗费用控制措施中，不属于控制医疗服务供方措施的是
A. 设置最高支付限额
B. 按服务单元付费
C. 总额预付制
D. 按人头预付方式
E. 按病种给付方式

正确答案：A。设置最高支付限额

解析：医疗服务供方的控制措施主要在改变费用支付方式，包括：（一）按病种付费（E对）（二）总额预付（C对）（三）按人头预付方式（D对）（四）按服务单元付费（B对）。控制医疗服务需方的措施主要是通过费用分担的方式，促使需方增加费用意识，主动控制医疗费用的不合理利用。主要的共付措施包括：（一）起付线（二）共付比例（三）封顶线也叫最高支付限额（A错，为本题正确答案）。